下列剂型中，既可内服又可外用的是
A. 肠溶片剂
B. 颗粒剂
C. 胶囊剂
D. 混悬剂
E. 糖浆剂

正确答案：D。混悬剂

解析：本题考查混悬剂。混悬剂（D对）系指难溶性固体药物以微粒状态分散于分散介质中形成的非均相液体制剂，如合剂、洗剂、混悬剂等，合剂口服，洗剂外用。肠溶片剂（A错）系指用肠溶性包衣材料进行包衣的片剂，属于口服制剂，只可口服，不能外用。颗粒剂（B错）系指药物与适宜的辅料混合制成的具有一定粒度的干燥颗粒状制剂，属于口服制剂，只可口服，不能外用。胶囊剂（C错）指原料药物与适宜辅料充填于空心胶囊或密封于软质囊材中的固体制剂，属于口服制剂，只可口服，不能外用。糖浆剂（E错）系指含有药物的浓蔗糖水溶液，供口服用，不能外用。